下列除哪项外,均可引起血清钾增高
A. 急、慢性肾衰竭
B. 静脉滴注大量钾盐
C. 严重溶血
D. 代谢性酸中毒
E. 代谢性碱中毒

正确答案：E。代谢性碱中毒

解析：急、慢性肾衰竭由于K+排出障碍，故导致血清钾增高（A对）。静脉滴注大量钾盐由于K+摄入增多，故导致血清钾增高（B对）。严重溶血导致血细胞大量破坏，使红细胞内的K+大量移到红细胞外，故导致血清钾增高（C对）。代谢性酸中毒时血液中H+增多，与细胞内的K+交换增强，使细胞内K+大量移到细胞外，故导致血清钾增高（D对）。代谢性碱中毒时血液中H+减少，与细胞内的K+交换减弱，细胞外K+较少，故代谢性碱中毒时，血清钾减少（E错，为本题正确答案）。